患者，男，15岁。正畸需要减数拔牙，术中误将右下尖牙认为第一前磨牙拔除。患者，男，15岁。正畸需要减数拔牙，术中误将右下尖牙认为第一前磨牙拔除。如进行上述治疗方法，应满足的条件中包括
A. 牙周无病变
B. 根尖周无病损
C. 患者年龄小
D. 牙根尚未发育完全
E. 以上均是

正确答案：E。以上均是

解析：本题考查牙槽外科。牙再植的适应证有：外伤脱位、牙体缺损小、牙周及根尖周无病损的牙（AB对）；位置不正的、单根扭转牙，如无正畸条件者，也可行再植矫正；误拔的健康牙。再植牙一般以年龄小（C对）、牙根尚未发育完全（D对）、根尖孔呈喇叭状者效果良好。因此选E。